清洁水量BOD520一般应小于
A. 1mg/L
B. 2mg/L
C. 3mg/L
D. 4mg/L
E. 5mg/L

正确答案：A。1mg/L

解析：本题考查生化需氧量的相关内容。生化需氧量（BOD）指水中有机物在有氧条件下被需氧微生物分解时消耗的溶解氧量。清洁水生化需氧量一般小于1mg/L（A对BCDE错）。